男，18岁。腰痛，近期出现右膝痛，父亲有类似病史。首先应选择的检查是
A. 腰椎X线片
B. 骶骨关节X线片
C. 双肾CT
D. 腹部B超
E. MRI

正确答案：B。骶骨关节X线片

解析：青年男性患者（强直性脊柱炎好发人群），出现右膝关节痛（强直性脊柱炎常见表现），其父有类似病史（强直性脊柱炎与遗传因素相关），考虑患者最可能诊断为强直性脊柱炎（AS）。骶髂关节为强直性脊柱炎最早累及的部位，患者常出现腰背痛的症状，因此本例患者应作骶髂关节X线片（B对）以确定骶髂关节受累情况。腰椎X线片（A错）主要用于观察腰椎受累情况，但不如骶髂关节X线片特异性强。双肾CT（C错）和腹部B超（D错）主要用于辅助诊断泌尿系结石及肿瘤等，与本例描述不符。MRI（E错）虽可更好观察骶髂关节周围软组织受累情况，但不如X线片方便、经济。